供无破损皮肤揉擦用的液体制剂是
A. 搽剂
B. 甘油剂
C. 露剂
D. 涂膜剂
E. 醑剂

正确答案：A。搽剂

解析：本题考查搽剂。搽剂（A对）系指原料药物用乙醇、油或适宜的溶剂制成的溶液、乳状液或混悬液，供无破损皮肤揉擦用的液体制剂；甘油剂（B错）系指药物溶于甘油中制成的专供外用的溶液剂；露剂（C错）系指含挥发性成分的药材用水蒸气蒸馏法制成的芳香水剂；涂膜剂（D错）是指饮片经适宜溶剂和方法提取或溶解，与高分子成膜材料制成的供外用涂抹，能形成薄膜的液体制剂；醑剂（E错）系指挥发性药物的浓乙醇溶液，可以内服和外用。